已知最早的药物学专著是
A. 《神农本草经》
B. 《本草经集注》
C. 《新修本草》
D. 《本草纲目》
E. 《本草》

正确答案：A。《神农本草经》

解析：本题考查的是《神农本草经》。已知最早的药物学专著是《神农本草经》（A对）。《神农本草经》简称《本经》，为汉代本草代表作。该书系统总结了汉代以前我国药学发展的成就，是现存最早的药学专著，为本草学的发展奠定了基础。《本草经集注》（B错）为魏晋南北朝本草代表作。作者为陶弘景，该书第一次全面系统地整理、补充了《本经》，反映了魏晋南北朝时期的本草学成就，初步确立了综合性本草著作的编写模式。《新修本草》（C错）又称《唐本草》，为隋唐时期唐代的本草代表作。该书无论在内容和编写形式上都有新的突破，全面总结了唐以前的药物学成就，并很快流传于海内外，对后世医药学的发展影响极大。《本草纲目》（D错）简称《纲目》，为明代本草代表作。作者李时珍，在公元1578年（明万历六年）完成这一巨著。全书共52卷，约200万字，载药1892种，绘药图1100余幅，附方11000余首。